解救由蒽醌类抗肿瘤药导致的心肌炎，应当选用的药物是
A. 氟马西尼
B. 纳洛酮
C. 右雷佐生
D. 乙酰半胱氨酸
E. 泛癸利酮（辅酶Q10）

正确答案：C。右雷佐生

解析：本题考查药物中毒的解救。解救由蒽醌类抗肿瘤药导致的心肌炎，应当选用的药物是右雷佐生（C对）。右雷佐生在细胞内水解成开环形式后，具有螯合作用，能与柔红霉素、多柔比星复合物螯合，抑制自由基的产生，起到保护心肌的作用，减轻由蒽醌类抗肿瘤药所引起的心脏毒性。氟马西尼（A错）是苯二氮䓬类药物的解救药。纳洛酮（B错）是吗啡中毒的解救药。乙酰半胱氨酸（D错）是对乙酰氨基酚的解救药。泛癸利酮（辅酶Q10）（E错）一般用作充血性心力衰竭、冠心病、高血压、心律不齐的辅助治疗药。